对结核性腹膜炎最有诊断价值的检查是
A. PP试验
B. 结肠镜检查
C. 血沉
D. 腹水常规
E. 腹腔镜检查+腹膜活检

正确答案：E。腹腔镜检查+腹膜活检

解析：结核性腹膜炎是由结核分枝杆菌引起的慢性弥漫性腹膜感染，对其最有诊断价值的检查是腹腔镜检查+腹膜活检（E对），镜下见到结核结节、干酪样坏死灶即可确诊。PPD试验（A错）应用于检出结核分枝杆菌感染，而非检出结核病（P66），不用于确诊结核性腹膜炎。结肠镜检查（B错）主要用于溃疡性结肠炎、克罗恩病等肠道疾病，对结核性腹膜炎无诊断价值。血沉（C错）增高可见于多种疾病，如急性炎症、白血病、结缔组织病及结核病的活动期，不具有特异性。腹水常规（D错）可提示腹水性质，对结核性腹膜炎的诊断有一定价值，但不能确诊。